在脂肪动员过程中，甘油三酯脂肪酶是
A. 脂酰转移酶
B. 磷脂肪酸磷酸酶
C. 柠檬酸裂解酶
D. 脂肪动员的限速酶
E. 同工酶

正确答案：D。脂肪动员的限速酶

解析：脂肪细胞中储存的甘油三酯经一系列脂肪酶依次催化，逐步水解释放出甘油和游离脂肪酸，运送到全身各组织利用，此过程称为脂肪动员。在脂肪动员过程中，甘油三酯脂肪酶为脂肪动员的限速酶，因受多种激素调节，故又被称为激素敏感性脂肪酶。掌握“脂肪的分解代谢”知识点。